乳牙早失的原因，叙述正确的
A. 严重龋病，牙髓病和根尖周病
B. 恒牙异位萌出，乳牙根过早吸收
C. 外伤导致
D. 先天性牙齿缺失
E. 以上均正确

正确答案：E。以上均正确

解析：牙齿早失的原因如下：①严重龋病、牙髓病及根尖周病导致牙齿过早脱落或被移除；②恒牙异位萌出，乳牙根过早吸收脱落；③牙齿因外伤脱落；④先天性牙齿缺失。掌握“乳牙早失及间隙管理”知识点。